属于濒临灭绝状态，稀有珍贵野生药材物种实行
A. 二级保护
B. 三级保护
C. 限量出口
D. 一级保护

正确答案：D。一级保护

解析：本题考查的是国家重点保护野生药材物种的分级。属于濒临灭绝状态，稀有珍贵野生药材物种实行一级保护（D对）。国家重点保护野生药材物种的分级：国家重点保护的野生药材物种分为三级管理。一级保护野生药材物种：系指濒临灭绝状态的稀有珍贵野生药材物种。二级保护（A错）野生药材物种：系指分布区域缩小，资源处于衰竭状态的重要野生药材物种。三级保护（B错）野生药材物种：系指资源严重减少的主要常用野生药材物种。国家重点保护的野生药物种名录共收载了野生药材物种76种，中药材42种。其中一级保护的野生药材物种有4种，中药材4种；二级的野生药材物种27种，中药材17种；三级保护的野生药材物种45种，中药材21种。